鼻眶筛骨折的最主要的体征是
A. 眦距的变窄
B. 眼球内陷
C. 复视
D. 眶周淤血、肿胀
E. 眶下区麻木

正确答案：B。眼球内陷

解析：眼球内陷：是眶底和鼻眶筛骨折的重要体征。造成眼球内陷的主要原因是：①因眶底或内侧壁骨折，眶内容连同眼球向下、向内移位，或疝入上颌窦腔内或筛窦内；②眶底或内侧壁移位后，眶腔容积增大，眶内脂肪支持眼球的量不足所致。掌握“颧骨及颧弓、眼眶骨折及骨折愈合过程”知识点。